饮水的适宜氟浓度一般保持
A. 0.4～0.7mg/L
B. 0.5～1.0mg/L
C. 0.6～0.9mg/L
D. 0.7～1mg/L
E. 0.8～1.5mg/L

正确答案：D。0.7～1mg/L

解析：饮水的适宜氟浓度一般应保持在0.7～1mg/L。掌握“氟的全身及局部应用”知识点。